易引起氧化降解的是
A. 酚类药物
B. 酰胺类药物
C. 酯类药物
D. 蛋白质类药物
E. 苷类药物

正确答案：A。酚类药物